替牙期乳牙根吸收属于
A. 生理性吸收
B. 病理性吸收
C. 生理性破坏
D. 病理性破坏
E. 以上都不对

正确答案：A。生理性吸收

解析：本题考查乳牙牙根生理性吸收。替牙期乳牙根吸收属于生理性吸收（A对）。乳牙牙根是人体中唯一能生理性吸收、消失的硬组织，其吸收呈间断性，有活动期和静止期。